足月妊娠时的羊水量约为
A. 1000ml
B. 800ml
C. 600ml
D. 400ml
E. 300ml

正确答案：B。800ml

解析：足月妊娠是指妊娠满37周至不满42足周期间分娩。正常妊娠38周约1000ml（A对），妊娠40周羊水量约800ml（B对）。按八版教材本题AB均为正确答案，但原答案为B。三版八年制妇产科学P41：妊娠足月羊水量约800ml。按三版八年制教材，本题B为正确选项。